Allis法治疗的是
A. 膝关节脱位
B. 髋关节脱位
C. 肘关节脱位
D. 肩关节脱位
E. 腕关节脱位

正确答案：B。髋关节脱位

解析：髋关节脱位（B对）以后脱位最常见，常用的复位方法为Allis法（P655）。膝关节脱位（A错）多采用牵拉复位。肘关节脱位（C错）常用复位手法有Parvin法、Meyn法、牵拉法、膝顶法、旋转法（第三版实用外科学P2041-2042）。肩关节脱位（D错）一般手法复位为局部麻醉下用Hippocrates法复位（P632）。